苯甲酸钠的存在下咖啡因溶解度显著增加，加入的苯甲酸钠是作为
A. 潜溶剂
B. 增溶剂
C. 絮凝剂
D. 消泡剂
E. 助溶剂

正确答案：E。助溶剂

解析：本题考查液体制剂常用的附加剂。苯甲酸钠作为助溶剂（E对）能够增加咖啡因的溶解度；潜溶剂（A错）系指能形成氢键以增加难溶性药物溶解度的混合溶剂；增溶（B错）指具有增溶能力的表面活性剂；絮凝剂（C错）可以使微粒ζ（Zeta）电位降低；消泡剂（D错）是可消除泡沫的物质。